下列关于老年人髓腔解剖的叙述中，不恰当的一项是
A. 髓腔明显变小
B. 牙髓的恢复能力强
C. 牙髓组织萎缩
D. 根管变细
E. 纤维成分显著增加而细胞成分减少

正确答案：B。牙髓的恢复能力强

解析：老年人整个髓腔明显变小，牙髓组织萎缩，纤维成分显著增加而细胞成分减少，牙髓的恢复能力弱，治疗效果较差，这些改变可以作为选择治疗方法的依据。掌握“髓腔各部分名称、增龄性变化及临床意义”知识点。